卫生数越小表示
A. 土壤污染越严重
B. 土壤越清洁
C. 土壤在卫生学上安全
D. 土壤在流行病学上安全
E. 以上都不对

正确答案：A。土壤污染越严重

解析：本题考查土壤卫生数。土壤卫生数是表示土壤污染程度的重要指标，它可以反映土壤中挥发性有机物、重金属、有毒有害物质、养分等的含量和程度。一般来说，土壤的卫生数越小，表明该土壤中含有的有毒物质越多，土壤的污染程度也就越严重（A对BCDE错）。